牙胚是在哪个时期形成的
A. 成釉器的蕾状期
B. 成釉器的帽状期
C. 成釉器的钟状期
D. 钟状期末期
E. 蕾状期末期

正确答案：B。成釉器的帽状期

解析：帽状期成釉器凹陷所包绕的间充质细胞不断增生，形成牙乳头。环绕成釉器和牙乳头的间充质则形成牙囊。成釉器、牙乳头和牙囊即构成牙胚，成为牙胚及其支持组织的形成者。因此，牙胚是在成釉器的帽状期形成的。掌握“牙胚的发生及分化”知识点。